女，14岁。初潮后月经周期紊乱，经期长短不一已有4个月。肛门检査：子宫发育正常，双侧附件未见异常。首选的辅助检查是
A. B型超声检查
B. 基础体温测定
C. X线检查
D. 血雌激素水平测定
E. 诊断性刮宫

正确答案：B。基础体温测定

解析：女，14岁（无排卵性功血好发于青春期和绝经过渡期），初潮后月经周期紊乱，经期长短不一已有4个月（无排卵性功血最常见的症状表现为月经周期紊乱，经期长短不一），子宫发育正常，双侧附件未见异常。结合患者的临床表现，可诊断为无排卵性功能失调性子宫出血。无排卵性功能失调性子宫出血首选的辅助检查是基础体温测定（B对），它不仅有助于判断有无排卵，还可提示黄体功能不足。B型超声检查（A对）可以了解子宫内膜厚度及回声，以明确有无宫腔占位病变及其他生殖道器质性病变等，但不是首选检查（P346）。X线检查（C错）对无排卵性功能失调性子宫出血无诊断价值。用于诊断无功能失调性子宫出血的一般是孕酮，而不是血雌激素水平测定（D错），且常因出血频繁，难以选择测定孕激素的时间（P346）。诊断性刮宫（E错）适用于年龄＞35岁、药物治疗无效或存在子宫内膜癌高危因素的异常子宫出血患者（P347）。